模型观测器的分析工具倒凹尺宽度分别为
A. 0.10mm、0.15mm、0.25mm
B. 0.20mm、0.5mm、0.75mm
C. 0.25mm、0.5mm、0.75mm
D. 0.3mm、0.55mm、0.75mm
E. 0.35mm、0.55mm、0.75mm

正确答案：C。0.25mm、0.5mm、0.75mm

解析：倒凹尺（末端有一圈侧方突起，突起的宽度有0.25mm、0.5mm、0.75mm三种）、成形蜡刀。掌握“局部义齿类型，肯氏分类及模型观测”知识点。